单侧下颌角骨折的最佳固定方法是
A. 单颌固定
B. 颅颌绷带固定
C. 坚固内固定
D. 钢丝内固定
E. 颌间固定

正确答案：C。坚固内固定

解析：本题考查颌骨骨折的固定方法。单侧下颌角骨折的最佳固定方法是坚固内固定（C对）。1.颌骨骨折开放复位坚固内固定的适应证为：（1）多发性或粉碎性上、下颌骨骨折。（2）全面部骨折。（3）有骨缺损的骨折。（4）大的开放性移位骨折。（5）明显移位的上、下颌骨骨折。（6）无牙颌及萎缩的下颌骨骨折。（7）感染的下颌骨骨折。2.单颌固定（A错）：是指在发生骨折的颌骨上进行固定，而不将上、下颌骨同时固定在一起的方法。主要用于线形并且移位不大的骨折。但单纯使用时固定力不足，目前多作为内固定的辅助方法。3.颌间固定（E错）：是指利用牙弓夹板将上、下颌单颌固定在一起，是颌面外科最常使用的固定方法。它的优点是能使移位的骨折段保持在正常咬合关系上愈合。目前，它的作用只是在术前牵引和手术中和术后短期维持咬合关系。